代谢活化是指
A. 一相反应可以增毒，二相反应可以减毒
B. 经结合反应后，水溶性增大，毒性也增大
C. 原形不致癌的物质经过生物转化变为致癌物
D. 减毒或增毒必须经过四种反应

正确答案：C。原形不致癌的物质经过生物转化变为致癌物

解析：本题考查代谢活化。代谢活化是指原形不致癌的物质经过生物转化变为致癌物（C对ABD错）。